在制定环境中必需微量元素的卫生标准时，应考虑
A. 平均浓度值
B. 适宜浓度范围
C. 上限浓度值
D. 下限浓度值
E. 最高容许浓度值

正确答案：B。适宜浓度范围

解析：本题考查环境中必需微量元素的卫生标准制订。在制订环境中必需微量元素的卫生标准时，应考虑适宜浓度范围（B对ACDE错），即不得低于较低的一个阈值和不超过另一个较高的阈值。